青皮的功效有
A. 燥湿
B. 疏肝
C. 散结
D. 破气
E. 消滞

正确答案：B、C、D、E。疏肝；散结；破气；消滞

解析：本题考查的是青皮的性能特点与功效。青皮的功效有疏肝（B对）、散结（C对）、破气（D对）与消滞（E对）。青皮：【性能特点】本品苦降下行，辛温行散，药力颇强，入肝、胆、胃经。既善疏肝破气，治肝郁胁痛、乳房疾患、寒疝腹痛；又善散结消滞，治癥瘕积聚、久疟癖块及食积腹痛。橘红：【功效】行气宽中，燥湿（A错）化痰，发表散寒。